《中国药典》中质量控制成分为香豆素类的有
A. 秦皮
B. 大黄
C. 前胡
D. 马兜铃
E. 补骨脂

正确答案：A、C、E。秦皮；前胡；补骨脂

解析：本题考查的是含香豆素类化合物的常用中药。《中国药典》中质量控制成分为香豆素类的有秦皮（A对）、前胡（C对）与补骨脂（E对）。秦皮的原植物主要有两种，即木犀科植物大叶白蜡树及白蜡树，大叶白蜡树皮中主要含七叶内酯（秦皮乙素）和七叶苷（秦皮甲素），而白蜡树皮中主要含白蜡素和七叶内酯以及白蜡树苷。《中国药典》采用高效液相色谱法并规定本品按干燥品计，含秦皮甲素、秦皮乙素的总量不得少于1.0%。前胡主要化学成分为多种类型的香豆素及其糖苷、三萜糖苷及甾体糖苷、挥发油等。一般以香豆素类成分作为前胡定量质量控制的指标。《中国药典》采用高效液相色谱法测定药材中白花前胡甲素和白花前胡乙素含量，其中白花前胡甲素含量不少于0.90%，白花前胡乙素不少于0.24%。补骨脂含有多种香豆素类成分，包括补骨脂内酯（补骨脂素）、异补骨脂内酯（异补骨脂素）和补骨脂次素等。《中国药典》采用高效液相色谱法测定药材中补骨脂素和异补骨脂素含量，两者总含量不得少于0.70%。大黄（B错）的质量控制成分为蒽醌类。从大黄中分离得到蒽醌、二蒽酮、芪、苯丁酮、单宁、萘色酮等不同种类的80多种化合物，大体上可分为蒽醌类、多糖类与鞣质类。其中蒽醌类及其衍生物含量为3%～5%，分为游离型与结合型。《中国药典》以总蒽醌和游离蒽醌为指标成分，采用高效液相色谱法测定药材和饮片中芦荟大黄素、大黄酸、大黄素、大黄酚和大黄素甲醚等总蒽醌的含量，要求药材总蒽醌不得少于1.5%，游离蒽醌不得少于0.20%。马兜铃（D错）主要含马兜铃酸类成分。其中最重要及做常见的一种是马兜铃酸Ⅰ（马兜铃酸A）。马兜铃酸可引起肾脏损害等不良反应。